患儿4岁。近1月来发热，面部苍白，多汗，易疲倦，近几日来四肢大关节游走性疼痛，为确定是否为风湿性关节炎，医生做了一些检查，下列哪项对风湿性的可能有提示作用
A. C反应蛋白
B. 抗“O”
C. 血沉
D. 心电图
E. 血常规

正确答案：B。抗“O”

解析：抗“O”（B对）试验有对风湿性关节炎的可能有提示作用。白细胞计数和中心粒细胞增高、血沉增快（C错）、C-反应蛋白阳性（A错）、α2球蛋白和黏蛋白增高等，但仅能反映疾病的活动情况，对诊断本病并无特异性。心电图（D错）可提示风湿性心脏炎，而非风湿性关节炎。血常规（E错）仅能判断患儿是否有感染，且特异性低，因此对风湿性关节炎并没有提示作用。